属于Ⅱ型超敏反应的疾病是
A. 新生儿溶血症
B. 血清病
C. SLE
D. 过敏性鼻炎
E. 溃疡性结肠炎

正确答案：A。新生儿溶血症

解析：临床上常见的Ⅱ型超敏反应疾病有：输血反应，新生儿溶血症、自身免疫性溶血性贫血、药物过敏性血细胞减少症、药物过敏性血细胞减少症等。掌握“概述及Ⅰ型超敏反应”知识点。